某男，65岁，耳中如蝉鸣，时作时止，按之鸣声减弱，听力亦下降，同时伴腰膝酸软，乏力脉虚细治疗宜选取
A. 翳风、侠溪、中渚、太冲、丘墟
B. 翳风、侠溪、中渚、外关、合谷
C. 太溪、照海、听宫、脾俞、足三里
D. 太溪、照海、听宫、肾俞、气海
E. 太溪、照海、听宫、肾俞、肝俞

正确答案：D。太溪、照海、听宫、肾俞、气海

解析：患者耳中如蝉鸣，时作时止，按之鸣声减弱，听力亦下降，诊为耳鸣之虚症，治宜补肾养窍，以局部选穴及足少阴肾经腧穴为主。主穴听宫、翳风、太溪、肾俞、照海等。《医林绳墨·耳》：耳属少阴肾经，肾之窍也。肾气实，则耳聪；肾气虚，则耳聋。“肾精不足，无以上荣于耳窍，为耳聋虚证之主要病机”。听宫为手太阳经与手、足少阳经之交会穴，气通耳内，具有聪耳启闭之功，为治耳疾要穴，配手少阳经局部的翳风穴，可疏导少阳经气，宣通耳窍。太溪、肾俞能补肾填精，上荣耳窍。照海为足少阴经和阴跷脉之会，既主一身左右之阴，又可疏通足少阴肾经。气海即人体元气的海洋，具有较好的补益元气之功，古人说“气海一穴暖全身”，就是说气海有强壮全身的作用，可以调整全身虚弱状态，增强免疫防卫功能。诸穴合用，可治肾精亏虚之耳鸣（D对）。